共同参与型这种模式主要适用于
A. 慢性病患者
B. 急性病患者
C. 精神患者
D. 全麻的患者
E. 昏迷、休克病人

正确答案：A。慢性病患者

解析：共同参与型这种模式主要适用于慢性疾病的治疗，因为这些病人自身的经验常常为治疗提供了重要的线索，即所谓“久病成良医”，而医生只起一种指导性的辅助作用，帮助病人自我治疗。掌握“医患沟通的理论、技术与其应用以及医患关系模式”知识点。